属于阿司匹林的不良反应是
A. 嗜睡
B. 心动过速
C. 呼吸抑制
D. 凝血障碍
E. 戒断症状

正确答案：D。凝血障碍

解析：本题考查阿司匹林的不良反应。阿司匹林能够抑制血小板聚集，大剂量或长期使用可能出现凝血障碍（D对）。阿司匹林的不良反应还有消化道黏膜损伤，少见特异质患者出现荨麻疹、黏膜充血、哮喘等过敏反应。